儿童从学校返回家中，出现鼻塞、喷嚏等症状。全身伴发热、头痛、咽痛、肌肉酸痛等。学校有数人同样有此表现。考虑诊断为
A. 疱疹性咽峡炎
B. 上呼吸道感染
C. 急性流行性感冒
D. 过敏性鼻炎
E. 手足口病

正确答案：C。急性流行性感冒

解析：本题考查急性流行性感冒。儿童从学校返回家中，出现鼻塞、喷嚏等症状。全身伴发热、头痛、咽痛、肌肉酸痛等。学校有数人同样有此表现。考虑诊断为急性流行性感冒（C对）。1.流行性感冒，简称流感，流感在中国以冬春季多见，临床表现以高热、乏力、头痛、咳嗽、全身肌肉酸痛等全身中毒症状为主，而呼吸道症状较轻。2.疱疹性咽峡炎（A错）是由肠道病毒引起的以急性发热和咽峡部疱疹溃疡为特征的急性传染性咽颊炎，以粪-口或呼吸道为主要传播途径，传染性很强，传播快，遍及世界各地，呈散发或流行，夏秋季为高发季节，主要侵犯1～7岁小儿。临床以发热、咽痛、咽峡部黏膜小疱疹和浅表溃疡为主要表现。为自限性疾病，一般病程4～6日，重者可至2周。3.急性上呼吸道感染（B错）简称上感，又称感冒。是包括鼻腔、咽或喉部急性炎症的总称。4.过敏性鼻炎（D错）即变应性鼻炎，其典型症状主要是阵发性喷嚏、清水样鼻涕、鼻塞和鼻痒。部分伴有嗅觉减退。5.手足口病（E错）多发生于5岁以下儿童，表现口痛、厌食、低热、手、足、口腔等部位出现小疱疹或小溃疡，多数患儿一周左右自愈，少数患儿可引起心肌炎、肺水肿、无菌性脑膜脑炎等并发症。个别重症患儿病情发展快，导致死亡。